龙胆草的功效有
A. 清热
B. 燥湿
C. 杀虫
D. 利尿
E. 泻肝火

正确答案：A、B、E。清热；燥湿；泻肝火